能平肝疏肝，祛风明目的药物是
A. 白僵蚕
B. 地龙
C. 刺蒺藜
D. 石决明
E. 代赭石

正确答案：C。刺蒺藜

解析：刺蒺藜的功效是平肝疏肝，祛风明目（C对）。白僵蚕的功效是息风止痉，祛风止痛，化痰散结（A错）。地龙的功效是清热熄风，通络，平喘，利尿（B错）。石决明的功效是平肝潜阳，清肝明目（D错）。代赭石的功效平肝潜阳，重镇降逆，凉血止血（E错）。